下列关于淡漠型甲状腺功能亢进症，哪一项是错误的
A. 多见于老年
B. 常缺乏神经兴奋性增高的表现
C. 明显乏力，消瘦，甚至恶病质
D. 长期甲状腺功能亢进，导致各系统的极度衰竭
E. 病情较轻，不易发生甲状腺危象

正确答案：E。病情较轻，不易发生甲状腺危象